善于治疗胃痛呕血呕吐暑热病的腧穴是
A. 内关
B. 劳宫
C. 间使
D. 外关
E. 曲泽

正确答案：E。曲泽

解析：曲泽属于手厥阴心包经腧穴，主治心痛、心悸、善惊等心系病证；胃痛、呕血、呕吐等胃热病证；暑热病；肘臂挛痛，上肢颤动（E对）。内关主治心痛、胸闷、心动过速或过缓等心系病证；胃痛、呕吐、呃逆等胃腑病证；中风，偏瘫，眩晕，偏头痛；失眠、郁证、癫狂病等神志病证；肘、臂、腕挛痛（A错）。劳宫主治中风昏迷、中暑等急症；心痛、烦闷、癫狂病等心与神志病证；口疮，口臭；鹅掌风（B错）。间使主治心痛、心悸等心系病证；胃痛、呕吐等胃热病证；热病，疟疾；癫狂痫；腋肿，肘、臂、腕挛痛（C错）。外关主治热病；头痛、目赤肿痛、耳鸣、耳聋等头面五官病证；瘰疬；胁肋痛；上肢痿痹不遂（D错）。